《中华人民共和国药典临床用药须知（2010年版）》中规定必须做皮肤敏感试验的药物有
A. 青霉素钠
B. 阿奇霉素
C. 阿莫西林
D. 破伤风抗毒素
E. 甲钴胺

正确答案：A、D。青霉素钠；破伤风抗毒素

解析：本题考查皮试。《中华人民共和国药典临床用药须知》中规定必须做皮肤敏感试验的常用药物有门冬酰胺酶注射剂、降纤酶注射剂、抑肽酶注射剂、玻璃酸酶注射剂、α-糜蛋白酶注射剂、青霉素钾注射剂、青霉素钠注射剂（A对）、白喉抗毒素注射剂、破伤风抗毒素注射剂（D对）、多价气性坏疽抗毒素注射剂、肉毒抗毒素注射剂等。